被注销注册，收回医师执业证书的当事人有异议的，依法申请复议或者起诉的期限是自收到注销注册通知之日起
A. 7日内
B. 10日内
C. 15日内
D. 20日内
E. 30日内

正确答案：C。15日内